肝十二指肠韧带内，不包括
A. 肝门静脉
B. 肝固有动脉
C. 胆总管
D. 肝静脉
E. 神经、淋巴管

正确答案：D。肝静脉

解析：肝十二指肠韧带内包括胆总管（C对），肝门静脉（A对）和肝固有动脉（B对），淋巴管及神经等（E对），肝静脉（D错,为本题正确答案）出肝后立即注人下腔静脉。